许勒位片可显示颞下颌关节
A. 顶部影像
B. 后前部影像
C. 外侧1/3影像
D. 中部1/3影像
E. 内侧1/3影像

正确答案：C。外侧1/3影像

解析：本题考查许勒位片的应用。外侧1/3影像（C对）是许勒位片可显示的颞下颌关节的部位。许勒位片颞骨岩部投影于踝突的下方，可显示关节窝、关节结节、踝突及关节间隙。后前部影像（B错）可通过髃突经咽侧位片观察到髁突前后斜侧位部分。顶部影像（A错）和中部1/3影像（D错）由于许勒位片投照时的角度是X线中心线向足侧倾斜，对准对侧的外耳道口上方5cm处射入，无法显示完整清晰影像。内侧1/3影像（E错）可由下颌骨开口后前位片观察。